关于散剂生产与贮藏有关规定的说法，错误的是
A. 儿科用散剂应为最细粉
B. 局部用散剂应为最细粉
C. 多剂量包装的散剂应附分剂量用具
D. 含挥发性药物的散剂应密封贮存
E. 含易吸潮药物的散剂应密闭贮存

正确答案：E。含易吸潮药物的散剂应密闭贮存

解析：本题考查的是散剂生产与贮藏的有关规定。含易吸潮药物的散剂应密封贮存（E错，为本题正确答案）。散剂的质量要求：（1）供制备散剂的原料药均应粉碎。除另有规定外，内服散剂应为细粉；儿科用及局部用散剂应为最细粉（AB对）；眼用散剂应为极细粉，且应无菌。按照《中国药典》要求，细粉系指能全部通过五号筛，并含能够通过六号筛不少于95%的粉末；最细粉系指能全部通过六号筛，并含能够通过七号筛不少于95%的粉末；极细粉系指能全部通过八号筛，并含能够通过九号筛不少于95%的粉末。（2）散剂应干燥、疏松、混合均匀、色泽一致。制备含有毒性药、贵重药或药物剂量小的散剂时，应采用配研法混匀并过筛。（3）多剂量包装的散剂应附分剂量的用具（C对）；含有毒性药的内服散剂应单剂量包装。（4）散剂中可含或不含辅料。口服散剂需要时亦可添加矫味剂、芳香剂、着色剂等。（5）除另有规定外，散剂应密闭贮存，含挥发性药物或易吸潮药物的散剂应密封贮存（D对）。生物制品应采用防潮材料包装。（6）为防止胃酸对散剂中活性成分的破坏，散剂稀释剂中可选用中和胃酸的辅料。（7）散剂用于烧伤治疗，如为非无菌制剂的，应在标签上标明“非无菌制剂”；产品说明书中应注明“本品为非无菌制剂”，同时在适应症下应明确“用于程度较轻的烧伤（Ⅰ度或浅Ⅱ度）”；注意事项下规定“应遵医嘱使用”。